女，42岁，左眼睑下垂3天，突发剧烈头痛1小时，伴恶心、呕吐。查体:神情语利，左睑下垂，遮盖瞳孔，左眼瞳孔扩大，对光反射消失，眼球处于外展位，内收及上下视受限。该患者最可能发生的情况是
A. 重症肌无力
B. 短暂性脑缺血发作
C. 蛛网膜下腔出血
D. 脑内出血
E. 硬膜下血肿

正确答案：C。蛛网膜下腔出血

解析：突发剧烈头痛1小时，伴恶心、呕吐（蛛网膜下腔出血的临床表现），体:神清语利，左睑下垂，遮盖瞳孔，左眼瞳孔扩大，对光反射消失，眼球处于外展位，内收及上下视受限（眼部症状），考虑为蛛网膜下腔出血。重症肌无力由神经肌肉传递障碍引起的骨骼肌收缩无力为主要症状，也就是附着在骨骼上、能够做出动作的肌肉逐渐失去力量。起初，患者容易疲劳，在活动后感觉更加劳累，休息后能得到缓解，可表现为眼睑下垂、吞咽困难、讲话无力，甚至呼吸困难（A错）；TIA患者可突然出现身体一侧麻木、无力、视力下降、言语障碍等症状。症状持续时间短，一般在1个小时内恢复，不遗留永久的损害或梗死灶（B错）。脑出血50～65岁多见。